小儿化脓性脑膜炎的脑脊液变化为
A. 细胞数增高，蛋白正常，糖降低
B. 细胞数增高，蛋白增高，糖降低
C. 细胞数正常，蛋白正常，糖降低
D. 细胞数增高，蛋白升高，糖升高
E. 细胞数增高，蛋白正常，糖正常

正确答案：B。细胞数增高，蛋白增高，糖降低

解析：典型化脑的脑脊液外观混浊，压力增高，白细胞总数显著增多，达1000×10⁶/L，分类以中性粒细胞为主，糖含量明显降低，常<1.1mmol/L，蛋白质含量增高，多>1g/L（B对）。